属于卵巢性索-间质细胞肿瘤的是
A. 胚胎癌
B. 颗粒细胞癌
C. 绒毛膜癌
D. 卵巢甲状腺肿
E. 畸胎瘤

正确答案：B。颗粒细胞癌

解析：卵巢性索-间质细胞肿瘤包括颗粒细胞癌（B对）、卵泡膜细胞瘤、纤维瘤、睾丸母细胞瘤等。胚胎癌（八年制第2版妇产科学P350）（A错）、绒毛膜癌（八年制第2版妇产科学P350）（C错）、畸胎瘤（P329）(E错）包括卵巢甲状腺肿（P329）（D错）属于卵巢生殖细胞肿瘤。